男，5岁。患结核性脑膜炎，控制炎症首选的治疗是
A. 链霉素+异烟肼+利福平+吡嗪酰胺
B. 链霉素+异烟肼
C. 链霉素+对氨基水杨酸钠
D. 链霉素+异烟肼+对氨基水杨酸钠
E. 异烟肼+对氨基水杨酸钠

正确答案：A。链霉素+异烟肼+利福平+吡嗪酰胺

解析：儿童结核性脑膜炎抗结核治疗，联合应用易透过血脑屏障的抗结核杀菌药物，分阶段治疗。（1）强化治疗阶段：联合使用异烟肼（INH）、利福平（RFP）、吡嗪酰胺（PZA）及链霉素（SM），疗程为3-4月（A对）。（2）巩固治疗阶段：继续应用INH、RFP或EMB。RFP或EMB 9-12月（BCDE错）。